痰留经络筋骨引发的病证不包括
A. 瘰疬痰核
B. 肢体麻木
C. 阴疽流注
D. 痹痛关节红肿
E. 半身不遂

正确答案：D。痹痛关节红肿

解析：本题考查的是痰饮的致病特点。痰留经络筋骨引发的病证不包括痹痛关节红肿（D错，为本题正确答案）。痰饮可阻滞气血运行：痰饮为实邪，可随气流行全身，或停滞于经脉，或留滞于脏腑，阻滞气机，妨碍气血运行。若痰饮流注于经络，则致经络气机阻滞，气血运行不畅，出现肢体麻木（B对），屈伸不利，甚至半身不遂（E对），或形成瘰疬痰核（A对），阴疽流注（C对）等；若痰饮留滞于脏腑，则阻滞脏腑气机，使脏腑气机升降失常。如痰饮阻肺，肺气失于宣降，则见胸闷气喘，咳嗽吐痰等；痰饮停胃，胃气失于和降，则见恶心呕吐等；痰浊痹阻心脉，血气运行不畅，可见胸闷心痛；无形之痰气结滞于咽喉，则形成“梅核气”，临床常见咽中梗阻如有异物，咽之不下，吐之不出，胸膈满闷，情绪低落，善太息等。